适宜卡介苗（BCG）接种的主要对象是
A. 结核性脑膜炎患者
B. 结核菌素试验阳性者
C. 严重的结核病患者
D. 新生儿以及结核菌素试验阴性的儿童
E. 细胞免疫功能低下者

正确答案：D。新生儿以及结核菌素试验阴性的儿童

解析：卡介苗是减毒的结核杆菌活疫苗，保持了良好免疫原性而无致病性。广泛接种卡介苗能大大降低结核病的发病率，婴幼儿免疫力低下，我国规定新生儿出生后即接种卡介苗，7岁或12岁复种一次，一般在接种6～8周后结核菌素试验转阳，则表示接种者已产生免疫力；阴性者应再行接种（D对）。结核菌素试验阳性者（B错）表明曾感染过结核菌或卡介苗接种成功，说明有特异性免疫力，无需接种。严重结核病者，如结核性脑膜炎患者（A错），严重肺结核病患者（C错）的结核菌素试验可能呈现阴性，由于卡介苗用于预防接种，对于已经感染者，接种卡介苗无预防作用，而应行抗结核治疗。结核分枝杆菌感染时，机体的抗结核免疫主要是细胞免疫，细胞免疫功能低下者（E错）接种卡介苗效果差。